下列最易岀现脑膜刺激征的是
A. 硬膜外出血
B. 脑出血
C. 脑梗死
D. 蛛网膜下腔出血
E. 高血压脑病

正确答案：D。蛛网膜下腔出血

解析：脑膜刺激征见于脑膜炎､蛛网膜下腔出血(D对）､脑水肿及颅内压增高｡